可促进组胺释放，引起支气管痉挛，从而引发哮喘的药物是
A. 普萘洛尔
B. 阿司匹林
C. 毛果芸香碱
D. 利多卡因
E. 地塞米松

正确答案：D。利多卡因

解析：本题考查麻醉性药物的作用机制。麻醉性药物氯胺酮、普鲁卡因、利多卡因（D对）等通过促进组胺释放而引起支气管痉挛。